属于无分流型先天性心脏病的是
A. 房间隔缺损
B. 室间隔缺损
C. 动脉导管未闭
D. 肺动脉狭窄
E. 法洛四联症

正确答案：D。肺动脉狭窄